高血压症状不包括
A. 呕吐
B. 头晕
C. 头痛
D. 心悸
E. 疲劳

正确答案：A。呕吐

解析：高血压一般常见症状有头晕、头痛、心悸、颈项板紧、疲劳等，呈轻度持续性，在紧张或劳累后加重，不一定与血压水平有关，多数症状可自行缓解。掌握“原发性高血压”知识点。